Dugas征表现阳性的是
A. 肩关节脱位
B. 肩锁关节脱位
C. 肱骨外科颈骨折
D. 肘关节脱位
E. 锁骨骨折

正确答案：A。肩关节脱位

解析：Dugas征阳性：为肩关节脱位的特异体征，即将病侧肘部紧贴胸壁时，手掌搭不到健侧肩部，或手掌搭在健侧肩部时，肘部无法贴近胸壁，提示肩关节脱位（A对）。肩锁关节脱位（B错）表现为肩锁关节处疼痛、肿胀，与对侧比较有时可发现患侧明显高起，按压有弹性感，肩活动受限。肱骨外科颈骨折（C错）主要表现为肩部肿胀、疼痛、活动受限，以中老年居多。肘关节后脱位（D错）检查可发现肘后三角关系发生改变，肘后出现空虚感，出现肘后突畸形；侧方托位可合并神经损伤，应检查手部感觉、运动功能。锁骨骨折（E错）患者常用健手托住肘部，头偏向患侧，以减少疼痛。